既治蛲虫病，又治阴痒的中药是
A. 广金钱草
B. 石韦
C. 萹蓄
D. 地肤子
E. 连钱草

正确答案：C。萹蓄

解析：本题考查萹蓄的主治病证。既治蛲虫病，又治阴痒的中药是萹蓄（C对）。萹蓄【主治病证】（1）热淋涩痛。（2）蛔虫病，蛲虫病。（3）湿疹，阴痒。广金钱草（A错）【主治病证】（1）石淋，热淋。（2）水肿尿少。（3）黄疸尿赤。石韦（B错）【主治病证】（1）血淋，热淋，石淋。（2）血热之崩漏、尿血、吐血、衄血。（3）肺热咳喘。地肤子（D错）【主治病证】（1）热淋。（2）风疹，湿疹，阴痒，湿疮。连钱草（E错）【主治病证】（1）石淋，热淋。（2）湿热黄疸。（3）疮痈肿痛，跌打损伤。